不属于原核细胞型微生物的是
A. 细菌
B. 病毒
C. 支原体
D. 立克次体
E. 衣原体

正确答案：B。病毒

解析：本题考查原核细胞型微生物。核细胞型微生物有细菌（A对）、支原体（C对）、立克次体（D对）、衣原体（E对）。病毒（B错）不具有细胞结构。